长期服用可引起甲状腺功能紊乱的药物是
A. 普萘洛尔
B. 苯妥英钠
C. 奎尼丁
D. 利多卡因
E. 胺碘酮

正确答案：E。胺碘酮

解析：本题考查胺碘酮。胺碘酮（E对）结构与甲状腺素类似，含有碘原子，长期服用故可影响甲状腺素代谢。普萘洛尔（A错）不良反应为加重支气管急性发作。苯妥英钠（B错）不良反应为降低心肌自律性。奎尼丁（C错）常见不良反应是胃肠道反应和中枢神经系统反应。利多卡因（D错）不良反应主要表现在中枢神经系统，如嗜睡、眩晕、头痛等。